不属于口服避孕药所致不良反应的是
A. 突破性出血
B. 低钙血症
C. 增加血栓栓塞性疾病风险
D. 月经失调
E. 体重增加

正确答案：B。低钙血症

解析：本题考查口服避孕药的不良反应。不属于口服避孕药所致的不良反应的是低钙血症（B错，为本题正确选项）。避孕药常见不良反应有：（1）类早孕样反应；（2）胃肠道反应；（3）月经失调；（4）出血（A对）；（5）妊娠斑；（6）体重增加等。